某医学生希望毕业后成为外科医师，因此他在临床实习中主动向老师请教，积极为患者服务，并能结合临床例案查阅相关的文献。他的行为表现在意志品质中称为
A. 自觉性
B. 坚韧性
C. 果断性
D. 自制力
E. 随意性

正确答案：A。自觉性

解析：意志的品质具有自觉性、果断性、坚韧性、自制性。自觉性（A对）是指能主动地支配自己的行动，使其能达到既定目标的心理过程。自觉性表现在个体具有明确的行动目的，并能充分认识行动效果的社会意义，使自己的行动符合社会、集体的利益，不屈从于周围人的压力，按照自己的信念、知识和行动方式进行行动的品质，题中医学生的行为正是如此。与自觉性相反的有意志的动摇性、受暗示性、盲从、随波逐流、刚愎自用和独断性等。坚韧性（B错）是指一个人能长期保持充沛的精力，战胜各种困难，不屈不挠地向既定的目的前进的品质。果断性（C错）是指人善于明辨是非，迅速而合理地采取决断，并实现目的的品质。自制性（D错）是指一种能够自觉地、灵活地控制自己的情绪和动机，约束自己的行动和语言的品质。